关于手术切口，哪项是错误的
A. 切口尽量与术区内重要的解剖结构相平行
B. 切口尽量与皮纹方向相一致
C. 为获得最小、最轻微的瘢痕，手术切口的形状最好是直线形
D. 手术切口应留有余地，以保留延长切口的可能
E. 活检手术切口力求与再次手术切口相一致

正确答案：C。为获得最小、最轻微的瘢痕，手术切口的形状最好是直线形

解析：本题考查手术切口。手术切口的形状最好是弧形和S形为好（C错，为本题的正确答案）。手术切口的设计要考虑术区内重要的解剖结构如神经、血管、腮腺导管等的位置和行径，切口应尽量与之平行（A对），以免意外损伤和不必要的牺牲。切口的方向要尽量与皮纹方向一致（B对），因皮肤张力方向与皮纹方向一致，以期望获得最小、最轻的瘢痕，满足美观和功能的需要。手术切口应留有余地，以保留延长切口的可能（D对）。活检手术切口力求与再次手术切口相一致（E对）。